药物治疗牙周病的原则，不正确的一项是
A. 牙周基础治疗效果不好的
B. 急性感染的牙周疾病
C. 用药前应清除菌斑、牙石
D. 尽量使用广谱抗生素
E. 尽量采用局部给药的途径

正确答案：D。尽量使用广谱抗生素

解析：牙周病药物治疗的原则如下：①遵循循证医学的原则，合理使用药物。一般情况下，牙龈炎和轻、中度的牙周炎不应使用抗菌药物。药物治疗应主要用于重度牙周炎患者、对常规牙周治疗反应不佳的患者及侵袭性牙周炎患者，必要时可以选择联合用药。②用药前应清除菌斑、牙石，“搅乱”生物膜的结构。③有针对性地用药。应尽量作细菌学检查及药敏试验，有针对性地选择窄谱的抗菌药物。④尽量采用局部给药途径，以避免和减少耐药菌株和毒副作用的产生。对于那些用于全身严重感染的强效抗菌药物，尽量不用于治疗牙周炎，以保护这些药物的有效性。掌握“慢性牙周炎的病因，表现诊断及预后”知识点。